腮腺扪诊的正确方法为
A. 以示、中、无名指3指提拉式扪诊为宜
B. 以示、中、无名指3指平触为宜
C. 双手双合诊
D. 双指合诊
E. 以拇指、示指挤触

正确答案：B。以示、中、无名指3指平触为宜